下列有关女童体格生长发育叙述正确的是
A. 3个月时为出生体重的0.5倍
B. 6个月时为出生体重的1倍
C. 9个月时为出生体重的1.5倍
D. 1周岁时为出生体重的2倍
E. 2周岁时为出生体重的4倍

正确答案：E。2周岁时为出生体重的4倍

解析：本题考查女童期的体格生长发育特点。2周岁时为出生体重的4倍（E对）；3个月时为出生体重的2倍（A错），与后9个月的增加值几乎相等（BC错）；1周岁时为出生时的3倍（D错）。